证见心胸烦热，口渴面赤，口舌生疮者，治疗方剂应选用
A. 六一散
B. 玉女煎
C. 导赤散
D. 芍药汤
E. 黄连解毒汤

正确答案：C。导赤散

解析：证见心胸烦热，口渴面赤，口舌生疮乃心经热盛所致。心火循经上炎，而见心胸烦热、面赤、口舌生疮；火热内灼，阴已不足，故见口渴；面赤为内热之象。心火上炎而又阴液不足，故治法不宜苦寒直折，而宜清心与养阴兼顾，利水以导热下行，使蕴热从小便而泄，用导赤散治疗。（C对）。六一散（A错）的功用为清暑利湿，主治暑湿证。玉女煎（B错）的功用为清胃热，滋肾阴，主治胃热阴虚证。芍药汤（D错）的功用为清热燥湿，调气和血，主治湿热痢疾。黄连解毒汤（E错）的功用为泻火解毒，主治三焦火毒热盛证。